关于雌、孕激素生物合成和代谢，正确的是
A. 卵巢不能合成雌酮
B. 孕激素来自雄烯二酮
C. 雌三醇活性最强
D. 雌激素是由颗粒细胞单独产生
E. 甾体激素主要在肝脏代谢

正确答案：E。甾体激素主要在肝脏代谢

解析：卵巢能合成雌激素、孕激素和少量的雄激素，它们均属于甾体激素，主要在肝内代谢（E对）。雌激素包括雌二醇、雌三醇、雌酮（A错），其中雌二醇的活性最强（C错）（P423）。雌激素的生成过程为：胆固醇→孕酮→雄烯二酮、睾酮（B错）→雌酮、雌二醇，即胆固醇→孕激素→雄激素→雌激素，雄激素的生成在卵泡膜细胞中进行，其转化为雌激素在颗粒细胞中进行（D错）（P19）。